脾在志为
A. 怒
B. 喜
C. 思
D. 悲
E. 恐

正确答案：C。思

解析：本题考查五脏与情志的关系，属于理解记忆内容。脾在志为思，是指脾的生理功能与思志相关（C对）。怒是人在情绪激动时的一种情志变化，由肝之精气所化，故说肝在志为怒（A错）。心在志为喜，是指心的生理功能与喜志有关（B错）。关于肺之志，《内经》有二说：一说肺之志为悲；一说肺之志为忧（D错）。恐，是一种恐惧、害怕的情志活动，与肾的关系密切（E错）。